坐骨神经损伤引起感觉缺失的部位是
A. 整个大腿、小腿和足
B. 大腿的后面、小腿后部区域和足底
C. 整个小腿和足
D. 小腿后部区的外侧部和足的大部分
E. 只有足底的大部分

正确答案：D。小腿后部区的外侧部和足的大部分

解析：坐骨神经的感觉纤维分布于小腿后部区的外侧部和足的大部分，损伤后可导致小腿后部区的外侧部和足的大部分（D对）感觉缺失。